某女，75岁。患风湿性关节炎，症见关节红肿热痛，伴有发热、汗出不解、口渴心烦、小便黄，舌红苔黄腻，脉滑数。证属湿热瘀阻经络。治当清热祛湿、活血通络定痛，宜选用的成药是
A. 天麻丸
B. 木瓜丸
C. 痛风定胶囊
D. 尪痹颗粒
E. 风湿骨痛胶囊

正确答案：C。痛风定胶囊

解析：本题考查的是痛风定胶囊的功能。患风湿性关节炎，症见关节红肿热痛，伴有发热、汗出不解、口渴心烦、小便黄，舌红苔黄腻，脉滑数。证属湿热瘀阻经络。治当清热祛湿、活血通络定痛，宜选用的成药是痛风定胶囊（C对）。痛风定胶囊：【功能】清热祛湿，活血通络定痛。天麻丸（A错）：【功能】祛风除湿，通络止痛，补益肝肾。木瓜丸（B错）：【功能】祛风散寒，除湿通络。风湿痛骨胶囊（E错）：【功能】温经散寒，通络止痛。蠲痹颗粒（D错），2022年考试指南未明确说明。蠲痹颗粒：【功能】温经散寒、祛风除湿、通络止痛。